患者女，39岁。现自觉颈前肿胀并伴有疼痛，发热、多汗、急躁、心悸半月，左侧甲状腺轻度肿大，心率100次/分，律齐。疑为亚急性甲状腺炎，应首先考虑的诊断是
A. Graves病
B. 桥本病
C. 单纯性甲状腺肿
D. 甲状腺腺瘤
E. 亚急性甲状腺炎

正确答案：E。亚急性甲状腺炎

解析：根据患者发热多汗急躁心悸半月等全身症状及甲状腺疼痛、轻度肿大且压痛，可初步判断为亚急性甲状腺炎（E对）；Graves病可以引起高代谢的症状，可以引起甲状腺弥漫性的肿大，可以引起突眼，可以引起甲状腺相关的粘液性水肿等（A错）；桥本病出现甲状腺弥漫性对称性肿大（B错）；早期一般无症状，甲状腺功能正常，肿大尚不严重；随疾病进展可出现颈部肿块，引起压迫症状，不会出现发热、多汗、急躁、心悸的症状（C错）；甲状腺腺瘤颈部有肿物，边界清楚，局限在一侧腺体内。肿物质地较周围甲状腺组织稍硬，表面光滑，无压痛，能随吞咽上下移动。没有发热、多汗、急躁、心悸的症状（D错）。